Ⅲ度骨吸收描述的骨破坏情况是
A. 牙槽骨吸收在根颈1/3以内
B. 牙槽骨吸收超过根长的1/3，但在根长2/3以内或达根长1/2
C. 牙槽骨吸收占根长的3/4以上
D. 牙槽骨吸收占根长的1/2以上，3/4以内
E. 牙槽骨吸收大于根长2/3

正确答案：E。牙槽骨吸收大于根长2/3

解析：本题考查骨吸收程度的分类。Ⅲ度骨吸收描述的骨破坏情况是牙槽骨吸收大于根长2/3（E对）。骨吸收程度代表牙周炎破坏程度，骨吸收程度越大说明牙周炎越严重。骨吸收的程度一般按吸收区占牙根长度的比例来描述，通常分为三度。Ⅰ度：牙槽骨吸收在牙根的颈1/3以内（A错）。Ⅱ度：骨吸收牙槽骨吸收超过根长1/3，但在根长2/3以内，或吸收达根长的1/2（B错）。Ⅲ：牙槽骨吸收大于根长2/3。无牙槽骨吸收占根长的3/4 以上（C错）、牙槽骨吸收占根长的1/2以上，3/4以内（D错）的分类方法。